与排卵后基础体温升高有关的激素是
A. 卵泡刺激素
B. 缩宫素
C. 雌激素
D. 黄体生成素
E. 孕激素

正确答案：E。孕激素

解析：孕激素（E对）主要作用于子宫内膜和子宫平滑肌，为受精卵的着床作好准备，并维持妊娠，并可导致排卵后的基础体温升高。卵泡刺激素（A错）、缩宫素（B错）、雌激素（C错）、黄体生成素（D错）都不可以导致排卵后的基础体温升高。